提高机体特异性免疫力的被动免疫是
A. 早期诊断、隔离并彻底治愈患者
B. 注意营养，锻炼身体
C. 彻底消毒疾病源地
D. 广泛接种疫苗
E. 注射抗毒素或丙种球蛋白

正确答案：E。注射抗毒素或丙种球蛋白